门诊给多动症患者开具哌醋甲酯的处方最多不超过
A. 15天
B. 7天
C. 3天
D. 14天
E. 10天

正确答案：A。15天

解析：门诊给多动症患者开具哌醋甲酯的处方最多不超过15天（A对）。